骨骼肌神经-肌接头兴奋传递中，兴奋到达轴突末梢，进入末梢膜内的离子流是
A. K⁺外流
B. Na⁺内流
C. Ca²⁺内流
D. Cl⁻内流
E. H⁺外流

正确答案：C。Ca²⁺内流